对纵隔的描述，哪项正确
A. 位于腹膜腔内
B. 下界是腹内筋膜
C. 容纳心、肺
D. 两侧界是纵隔胸膜
E. 两侧界是胸内筋膜

正确答案：D。两侧界是纵隔胸膜

解析：纵隔不位于腹膜腔内（A错）。纵隔下界是膈（B错）。肺位于胸腔内（C错）。纵隔两侧界是纵隔胸膜（D对E错）。